与血液运行关系最密切的脏腑是
A. 肝、脾、肾
B. 心、肝、脾
C. 心、肺、肾
D. 心、肝、肾
E. 肺、脾、肾

正确答案：B。心、肝、脾

解析：本题考查血液运行与相关脏腑的关系，属于理解记忆内容。肾中精气充足，则血液化生有源，同时肾精充足，肾气充沛，也可以促进脾胃的运化功能，有助于血液的化生，说明肾与血液生成过程有密切的关系，并不是与血液运行关系密切，故选项中含有肾的全部排除（ACDE错）。血液的正常运行，与心、肺、肝、脾等脏腑的功能密切相关，心气的推动、肺气的宣发肃降、肝气的疏泄是推动和促进血液运行的重要因素。脾气的统摄及肝气的藏血是固摄控制血液运行的重要因素（B对）。